初产妇，26岁。妊娠40周，规律宫缩8小时入院。查体：髂棘间径25cm，骶耻外径20cm，坐骨结节间径7.5cm。枕右前位，胎心134次/min。肛查宫口开大4cm，S0。1小时后产妇呼叫腹痛难忍，检查宫缩1~2分钟1次，持续45秒，胎心102次/min，子宫下段压痛明显。肛查宫口开大5cm，胎头“0”。此时产程受阻的主要原因是
A. 漏斗型骨盆
B. 扁平型骨盆
C. 中骨盆狭窄
D. 骨盆出口狭窄
E. 骨盆人口狭窄

正确答案：D。骨盆出口狭窄